患者，女，32岁。有甲状腺功能亢进症病史。颈前肿胀，烦躁易怒，易饥多食，恶热多汗，心悸头晕，大便秘结，失眠，舌红，苔黄，脉弦数。其中医治法是
A. 疏肝理气，化痰散结
B. 清肝泻火，消瘿散结
C. 滋阴降火，消瘿散结
D. 益气养阴，消瘿散结
E. 清肝泻火，益气养阴

正确答案：B。清肝泻火，消瘿散结

解析：痰气壅结于颈前故见颈前肿胀；郁久化火，肝火旺盛，则见烦躁易怒，易饥多食；肝火上炎，风阳内盛，则恶热多汗，心悸头晕；灼伤阴液则大便秘结；扰动心神故见失眠；舌红，苔黄，脉弦数均为肝火旺盛之侯，治疗应清肝泻火，消瘿散结（B对）。疏肝理气，化痰散结（A错）可以用于治疗气滞痰凝证。滋阴降火，消瘿散结（C错）用于治疗阴虚火旺证。益气养阴，消瘿散结（D错）用于治疗气阴两虚证。清肝泻火，益气养阴（E错）用于治疗肝火耗气伤阴证。